子宫颈癌的始发部位通常是
A. 子宫颈组织学内口区
B. 子宫颈管柱状上皮区
C. 子宫颈移行带区
D. 子宫颈解剖学内口区
E. 宫颈鳞状上皮区

正确答案：C。子宫颈移行带区

解析：子宫颈癌的始发部位通常是子宫颈移行带区（C对），子宫颈移行带区位于子宫颈鳞状上皮区（E错）与子宫颈管柱状上皮区（B错）交接部。子宫体与子宫颈之间形成的最狭窄的部分称为子宫峡部，在非孕期约长1cm。子宫峡部的上端因解剖上较狭窄，称为子宫颈解剖学内口区（D错）；下端因黏膜组织在此处由宫腔内膜转变为宫颈黏膜称为子宫颈组织学内口区（A错），二者均不是子宫颈癌的始发部位。